我国关于流行病学的定义与历史上哪位流行病学专家提出的定义相一致
A. Stallybrass
B. Mac Mahon
C. Lilienfeld
D. Last
E. Rothman

正确答案：D。Last

解析：本题考查流行病学定义。我国给出的流行病学定义是：流行病学是研究人群中疾病与健康状况的分布及其影响因素，并研究防制疾病及促进健康的策略和措施的科学。该定义与Last（D对ABCE错）提出的定义一致，既适合目前我国的卫生实践又充分显示了学科的本质。